阴虚火旺之心悸，若兼见五心烦热，梦遗腰痠者，治疗应首选
A. 天王补心丹
B. 六味地黄丸
C. 麦味地黄丸
D. 知柏地黄丸
E. 金锁固精丸

正确答案：D。知柏地黄丸

解析：肾阴虚，阴亏于下，则见梦遗腰酸；阴虚内热，则五心烦热，治宜滋阴降火，方选知柏地黄丸（D对）。天王补心丹功能滋阴养血，补心安神，为治疗心悸阴虚火旺的证选方（A错）。六味地黄丸功能滋养肾阴，为消渴下消之肾阴亏虚证的选方（B错）。麦味地黄丸功能补益肺肾，滋阴清热，可治疗自汗、盗汗阴虚火旺证以阴虚为主，而火热不甚，潮热、脉数等不显著者（C错）。金锁固精丸功能固肾摄精，为治疗遗精肾气不固证的选方（E错）。